黄体功能由胎盘完全取代于妊娠
A. 4周后
B. 6周后
C. 8周后
D. 10周后
E. 12周后

正确答案：D。10周后

解析：卵巢：略增大，一侧卵巢可见妊娠黄体，妊娠黄体于妊娠10周前产生雌激素及孕激素，以维持妊娠继续。黄体功能于妊娠10周后由胎盘完全取代。掌握“妊娠生理”知识点。